心源性哮喘宜选用
A. 肾上腺素
B. 去甲肾上腺素
C. 异丙肾上腺素
D. 哌替啶
E. 多巴胺

正确答案：D。哌替啶

解析：心源性哮喘是左心衰竭引起急性肺淤血、肺水肿，导致患者肺换气功能降低，体内缺氧和CO2蓄积，出现呼吸急促与窒息感，引起心源性哮喘。吗啡可降低呼吸中枢对CO2的敏感性，解除窒息感；扩张周围血管，减少回心血量，减轻心脏负担，还可消除病人焦虑和恐惧情绪。哌替啶作为吗啡类药物可代替吗啡应用于心源性哮喘。掌握“吗啡、哌替啶”知识点。